分布于枕叶的动脉
A. 脉络丛前动脉
B. 大脑中动脉
C. 大脑前动脉
D. 后交通动脉
E. 大脑后动脉

正确答案：E。大脑后动脉

解析：大脑后动脉分为皮质支和中央支。分布于枕叶的动脉位于大脑后动脉（E对）的皮质支。